婴幼儿时期绝大部分是
A. 真性近视
B. 假性近视
C. 斜视
D. 远视
E. 散光

正确答案：D。远视